走行于三角肌胸大肌间沟内
A. 贵要静脉
B. 头静脉
C. 锁骨下静脉
D. 颈外静脉
E. 肱静脉

正确答案：B。头静脉

解析：头静脉（B对）走行于三角肌胸大肌间沟内至锁骨下窝，穿深筋膜注入腋静脉或锁骨下静脉。